生命伦理学诞生于
A. 19世纪50、60年代，美国
B. 19世纪50、60年代，日本
C. 20世纪50、60年代，美国
D. 20世纪50、60年代，日本
E. 20世纪80、90年代，中国

正确答案：C。20世纪50、60年代，美国